患儿，10天。受寒后四肢发凉，面颊、小腿红肿如冻伤，难以捏起，反应尚可。其证候是
A. 阳气虚衰
B. 寒凝血涩
C. 气滞血瘀
D. 阳虚阴盛
E. 气虚血瘀

正确答案：B。寒凝血涩

解析：该题主要考查对硬肿症的辩证。寒凝血涩为硬肿轻症，多系体弱小儿中寒而致，先天不足，阳气薄弱，复感外寒。临床表现以全身寒冷、气滞血瘀为主，硬肿部位比较局限。该患儿，10天。受寒后四肢发凉，面颊、小腿红肿如冻伤，难以捏起，反应尚可。可判断为硬肿寒凝血涩证（B对）。阳气虚衰，证候全身冰冷，僵卧少动，反应极差，气息微弱，哭声低怯，吸吮困难，面色苍白，肌肤板硬而肿，范围波及全身，皮肤暗红，尿少或无，唇舌色淡，指纹淡红不显（A错）。硬肿证型中无气滞血瘀（C错）、阳虚阴盛（D错）、气虚血瘀（E错）。